影响药物作用的机体因素包括
A. 年龄
B. 性别
C. 精神状况
D. 种族
E. 个体差异

正确答案：A、B、C、D、E。年龄；性别；精神状况；种族；个体差异

解析：本题考查影响药物的作用因素。影响药物作用的因素：1.机体方面的因素：年龄（A对）、性别（B对）、病理状态、个体差异（E对）和遗传因素、种属差异（D对）等。2.药物方面的影响：剂型、剂量、给药途径、给药时间、反复用药、药物相互作用等。病人的精神状态（C对）和思想情绪往往也会影响药物的疗效。